行痹患者，关节疼痛，以肩、肘等上肢关节为甚。治疗应加用
A. 杜仲、桑寄生、巴戟天
B. 独活、牛膝、防己、萆解
C. 羌活、白芷、威灵仙、姜黄
D. 川乌、草乌
E. 白花蛇、乌梢蛇

正确答案：C。羌活、白芷、威灵仙、姜黄

解析：行痹若酸痛以肩肘等上肢关节为主者，可选加羌活、白芷、威灵仙、姜黄、川芎祛风通络止痛。若酸痛以下肢关节为主者，选加独活、牛膝、防己、萆藓通经活络，祛湿止痛。酸痛以腰背关节为主者，多与肾气不足有关，酌加杜仲、桑寄生、淫羊藿、巴戟天、续断等温补肾气。若见关节肿大，苔薄黄，邪有化热之象者，宜寒热并用，投桂枝芍药知母汤加减”（C对）（AB错)。川乌、草乌，适用于痛痹之寒湿甚者（D错）。白花蛇、乌梢蛇，适用于痹证久病入络者（E错）。